在社区获得性肺炎的致病菌中约占40%的是
A. 肺炎克雷伯杆菌
B. 流感嗜血杆菌
C. 肺炎军团菌
D. 葡萄球菌
E. 肺炎链球菌

正确答案：E。肺炎链球菌

解析：社区获得性肺炎（CAP）是指在医院外罹患的感染性肺实质炎症，包括具有明确潜伏期的病原体感染而在入院后平均潜伏期内发病的肺炎。CAP常见的致病菌依次为肺炎链球菌、支原体、衣原体、流感嗜血杆菌和呼吸道病毒等，其中最常见的是肺炎链球菌。肺炎球菌引起的肺炎在社区获得性肺炎的致病菌中约占半数，接近40%（E对）。